女，34岁。双侧乳房胀痛5年余。胀痛症状在月经前出现，自己在乳房触及到不规则的“包块”，来月经后症状缓解，“包块”变小，另外与情绪和疲劳有一定关系。对这种疾病的描述，错误的是
A. 多在双侧乳房出现不适症状
B. 癌变发生率髙，视为癌前病变
C. 腺体可能会发生增生萎缩等变化
D. 常见于25～45岁的女性
E. 一般认为与内分泌紊乱有关

正确答案：B。癌变发生率髙，视为癌前病变

解析：34岁女性（乳腺囊性增生病常见发病年龄），双侧乳房胀痛5年，可及乳房包块，经期前出现，经期后缓解（与月经周期相关的周期性乳房胀痛及肿块为乳腺囊性增生病的典型临床表现），诊断考虑乳腺囊性增生病。本病常见于25～45岁的女性（D对），一般认为与体内女性激素代谢障碍，尤其是雌、孕激素比例失调的内分泌紊乱有关（E对），乳腺腺体可能会发生增生、萎缩等变化（C对），典型临床表现为一侧或双侧乳房出现不适症状（A对）。单纯的囊性增生病很少有恶变（B错，为本题正确答案）；若伴有上皮不典型增生，特别是重度者，恶变可能性较大，则属于癌前期病变。